心为五脏六腑之大主的理论依据是
A. 心主血
B. 心主神志
C. 心主思维
D. 心总统魂魄
E. 心总统意志

正确答案：B。心主神志

解析：心藏神，又称心主神志（B对），指心统帅人体生命活动和主宰意识、思维等精神活动的机能。人体的脏腑、经络、形体、官窍，各有不同的生理机能，但都必须在心神的主宰和调节下分工合作，共同完成整体生命活动，心神正常，各脏腑机能协调有序，则身心康泰，神能驭气控精，并调节血液和津液的运行输布，而精藏于脏腑之中而为脏腑之精，脏腑之精所化之气为脏腑之气，脏腑之气则推动和调控着脏腑的机能。心神通过驾驭协调各脏腑之精气以达到调控各脏腑机能之目的。同时，心具有接受外界客观事物和各种刺激并作出反应，进行意识、思维、情感等活动的机能。心为精神之所舍，称为“五脏六腑之大主”。